慢性肺心病引起肺动脉高压最主要的原因是
A. 血液粘稠度增加
B. 血容量增加
C. 慢性炎症所致的肺动脉狭窄
D. 高碳酸血症
E. 缺氧性肺血管收缩

正确答案：E。缺氧性肺血管收缩

解析：慢性肺心病引起的肺动脉高压形成最主要的因素是缺氧性肺血管收缩（E对）。缺氧时收缩血管的物质增多，如白三烯、5-HT、血小板活化因子，血管紧张素Ⅱ等使肺血管收缩，血管阻力增加，另外，缺氧使平滑肌细胞膜对钙离子的通透性增加，肌肉兴奋-收缩偶联效应增强，直接使肺血管平滑肌收缩。高碳酸血症（D错）使血管对缺氧的收缩敏感性增强，致肺动脉压增高，是引起肺动脉高压的功能性因素之一，但不是最主要的原因。血液粘稠度增加（A错）及血容量增加（B错）也是引起肺动脉高压的原因，但较为少见，故其不是慢性肺心病引起肺动脉高压最主要的原因。慢性炎症所致的肺动脉狭窄（C错）为肺动脉高压形成的解剖学因素，对于肺动脉高压形成也有一定作用，但仅多见于肺疾病严重的患者，作用有限，故其不是慢性肺心病引起肺动脉高压最主要的原因。